针灸治疗崩漏虚证应选取
A. 三阴交足三里气海肾俞
B. 隐白血海阴陵泉关元
C. 三阴交肝俞气海
D. 关元隐白三阴交
E. 三阴交足三里气海

正确答案：A。三阴交足三里气海肾俞

解析：崩漏虚证选穴三阴交、足三里、气海、肾俞。三阴交治疗妇产科疾病、阴虚诸证；足三里治疗虚劳；气海治疗气虚病；肾俞治疗肾虚病证（A对）。隐白、血海、阴陵泉治疗妇科病，关元治疗元气虚损病（B错）。三阴交治疗妇产科疾病、阴虚诸证；肝俞治疗肝胆疾病；气海治疗气虚病（C错）。崩漏实证的主穴为关元、隐白、三阴交（D错）。三阴交治疗妇产科疾病、阴虚诸证；足三里治疗虚劳；气海治疗气虚病（E错）。